男，20岁。感冒后7天出现颜面及双下肢水肿，尿少，查体：BP160/100mmHg，尿蛋白（+++），尿沉渣：红细胞（++），Scr130umol/L，2周后少尿，BUN28mmol/L，Scr620umo/L，哪种疾病可能性大
A. 急性肾小球肾炎
B. 急进性肾小球肾炎
C. 慢性肾炎
D. 肾病综合征
E. 高血压肾病

正确答案：B。急进性肾小球肾炎

解析：青年男性患者，上感后1周出现颜面及双下肢水肿（肾性水肿），查体：血压160/100mmHg（2级高血压）。实验室检查：尿蛋白（+++），尿红细胞（++），Scr130umol/L【正常值（女）70～108μmol/L，肾功能轻度受损】，上述为典型的急性肾炎综合征表现。2周后少尿，BUN28mmol/L（正常值2.86～7.14mmol/L），Scr620umo/L，提示2周内肾功能出现恶化。符合急进性肾小球肾炎的临床特点（B对）。急性肾小球肾炎（A错）虽也有类似感冒的前驱症状，也会出现急性肾炎综合症表现，但是尿量多于1-2周后渐增，肾功能于利尿后数日可逐渐恢复正常（P466），与题中2周后肾功能急剧恶化不符。慢性肾小球肾炎（C错）病程长（须达3个月以上），发展慢，早期多表现为轻度尿异常，无明显的临床表现（P478）。肾病综合征（D错）诊断标准是：①尿蛋白大于3.5g/d；②血浆白蛋白低于30g/L；③水肿；④血脂升高。其中①②两项为诊断所必须（P470）。高血压肾病（E错）须有多年的高血压病史，且高血压肾病因损害肾小管的浓缩功能而常以夜尿增多为临床表现，不会出现血尿。